牙龈呈轻度炎症，有颜色改变，无肿胀或水肿，探诊后点状出血，SBI记分为
A. 0
B. 1
C. 2
D. 3
E. 4

正确答案：C。2

解析：2＝牙龈呈轻度炎症，有颜色改变，无肿胀或水肿，探诊后点状出血。掌握“牙周病流行病学及分级预防”知识点。